关于第三脑室的描述，错误的是
A. 位于两侧间脑之间
B. 前界为终板
C. 与第四脑室相通
D. 底为视交叉、灰结节和乳头体
E. 顶有胼胝体和穹窿形成

正确答案：E。顶有胼胝体和穹窿形成

解析：第三脑室为位于两侧间脑之间（A对）的一窄腔，其顶部为脉络丛（E错，为本题正确答案）；底为视交叉、灰结节、漏斗和乳头体（D对）；前界为终板（B对）；后经中脑导水管与第四脑室（C对）相通。